对下颌双侧游离缺失的可摘局部义齿基托的要求不正确的是
A. 有良好的封闭
B. 边缘圆钝，不刺激黏膜
C. 颊舌侧边缘伸展至黏膜皱折处
D. 不妨碍颊舌的功能运动
E. 后缘盖过磨牙后垫

正确答案：E。后缘盖过磨牙后垫

解析：本题考查局部义齿人工牙及基托。上颌后牙游离端义齿基托后缘应伸展到翼上颌切迹，远中颊侧应盖过上颌结节，后缘中部应到硬软腭交界处稍后的软腭上。下颌远中游离端基托后缘应覆盖磨牙后垫的前1/2～2/3（E错，为本题正确答案），舌侧远中进入下颌舌骨后窝。基托边缘不宜伸展到组织倒凹区，以免影响义齿就位或就位时擦伤倒凹以上突出部位的软组织。